湿热灭菌的优越性是
A. 能够损伤生物的核酸及酶类的物理灭菌方法
B. 穿透力强、灭菌可靠、不是物品升温
C. 使细菌DNA链上相邻的嘧啶碱基形成嘧啶二聚体，导致细菌死亡或突变
D. 适用于一次性塑料制品
E. 穿透力强、使菌体吸收水分易变性凝固以及蒸汽具有潜在的热能

正确答案：E。穿透力强、使菌体吸收水分易变性凝固以及蒸汽具有潜在的热能

解析：湿热灭菌的优越性在于穿透力强，使菌体吸收水分易变性凝固以及蒸汽具有潜在的热能。掌握“消毒与灭菌”知识点。